采用评分加权征询法设计的指数是
A. API指数
B. I₁指数
C. 等标污染负荷
D. Brown水质指数
E. 大气综合质量指数

正确答案：D。Brown水质指数